可抑制细菌DNA旋转酶的是
A. 磷霉素
B. 替考拉宁
C. 利福平
D. 舒巴坦
E. 左氧氟沙星

正确答案：E。左氧氟沙星

解析：本题考查左氧氟沙星。左氧氟沙星（E对）为氟喹诺酮类抗菌药物，其主要作用靶位在细菌的DNA拓扑异构酶。舒巴坦（D错）为β-内酰胺酶抑制剂。利福平（C错）能够特异性抑制敏感微生物的DNA依赖性RNA多聚酶。磷霉素（A错）能够抑制细菌细胞壁的早期合成。替考拉宁（B错）通过干扰肽聚糖的合成抑制细胞壁合成。